哺乳期妇女禁用的药物有
A. 甲巯咪唑
B. 环磷酰胺
C. 头孢拉定
D. 硫脲嘧啶
E. 碘阿芬酸

正确答案：A、B、D、E。甲巯咪唑；环磷酰胺；硫脲嘧啶；碘阿芬酸